某女，65岁，患有冠心病，伴慢性心功能不全，表现为心慌气短、动则加剧、下肢浮肿、倦怠乏力等症状，医师开具益气温阳、活血通络、利水消肿中药汤剂（黄芪、人参、黑顺片、丹参、葶苈子、水蛭、泽泻、桂枝、红花、香加皮），患者服用3剂后出现恶心、呕吐、腹泻、心率减慢、早搏等临床症状。上述与不良反应有关的中药，《中国药典》规定其内服剂量是
A. 9g～15g
B. 5g～10g
C. 3g～9g
D. 3g～6g
E. 1g～3g

正确答案：D。3g～6g

解析：本题考查的是毒性药材和饮片的用法用量。《中国药典》规定香加皮内服剂量是3g～6g（D对）。香加皮：有毒，用量3～6g。不宜过量。9g～15g（A错）为臭丹灵草的用量。臭丹灵草：有毒，用量9～15g。5g～10g（B错）为川楝子的用量。川楝子：有小毒，用量5～10g。外用适量，研末调涂。3g～9g（C错）为商陆的用量。商陆：有毒，用量3～9g。外用适量，煎汤熏洗。孕妇禁用。1g～3g（E错）为水蛭的用量。水蛭：有小毒，用量1～3g。孕妇禁用。